卵巢的固定结构是
A. 卵巢悬韧带
B. 卵巢固有韧带
C. 输卵管卵巢伞
D. 卵巢系膜
E. 上述全是

正确答案：E。上述全是

解析：卵巢悬韧带（A对）、卵巢固有韧带（B对）、输卵管卵巢伞（C对）和卵巢系膜（D对，E为本题正确答案）均为卵巢的固有结构。